药物从循环系统运送至体内各脏器组织中的过程
A. 肠肝循环
B. 首过效应
C. 胃排空速率
D. 吸收
E. 分布

正确答案：E。分布

解析：本题考查药物的体内过程。分布（E对）是指药物进入体循环后向各组织、器官或者体液转运的过程；吸收（D错）是药物从给药部位进入体循环的过程；肠肝循环（A错）是指随胆汁排入十二指肠的药物或其代谢物，在肠道中重新被吸收，经门静脉返回肝脏，重新进入血液循环的现象；首过效应（B错）指某些药物经胃肠道给药，在尚未吸收进入血循环之前，在肠黏膜和肝脏被代谢，而使进入血循环的原形药量减少的现象；胃排空速率（C错）为胃排空的快慢。